不适合高血压患者食用的食物是
A. 蔬菜
B. 水产品
C. 大豆制品
D. 菌藻类食物
E. 全脂奶油

正确答案：E。全脂奶油

解析：本题考查高血压的营养防治。高血压患者应克服不良饮食习惯，减少高能量密度食物的摄入，如肥肉、动物油脂、油炸食品、糖、甜点（E错，为本题正确答案）等。